主要用于治疗呼吸道合胞病毒感染的药物是
A. 拉米夫定
B. 更昔洛韦
C. 阿德福韦酯
D. 利巴韦林
E. 奥司他韦

正确答案：D。利巴韦林

解析：本题考查利巴韦林。主要用于治疗呼吸道合胞病毒感染的药物是利巴韦林（D对）。利巴韦林适用于呼吸道合胞病毒引起的病毒性肺炎与支气管炎，皮肤疱疹病毒感染，肝功能代偿期的慢性丙型肝炎患者。拉米夫定（A错）用于伴有丙氨酸氨基转氨酶升高和病毒活动复制的、肝功能代偿的成年慢性乙型肝炎病人的治疗。更昔洛韦（B错）用于免疫损伤引起巨细胞病毒感染的患者。阿德福韦酯（C错）用于治疗有乙型肝炎病毒活动复制证据，并伴有血清氨基酸转移酶（ALT或AST）持续升高或肝脏组织学活动性病变的肝功能代偿的成年慢性乙型肝炎患者。奥司他韦（E错）用于成人和1岁及1岁以上儿童的甲型和乙型流感治疗，用于成人和13岁及13岁以上青少年的甲型和乙型流感的预防。